急性细菌性痢疾病变最显著的部位是
A. 回肠末端
B. 直肠与乙状结肠
C. 升结肠
D. 降结肠
E. 整个结肠

正确答案：B。直肠与乙状结肠

解析：急性细菌性痢疾病变最显著的部位是大肠，以直肠与乙状结肠（B对）为主，重者可以波及整个结肠和回肠末端。菌痢的典型临床表现为腹泻+里急后重，里急后重即直肠刺激症状，而直肠刺激症状多发生于直肠。